Nelson主张
A. 以（牙合）力比值决定基牙数目
B. 以缺牙数决定基牙数目、
C. 以牙周膜面积决定基牙数目
D. 以缺牙部位决定基牙数目
E. 以上都不对

正确答案：A。以（牙合）力比值决定基牙数目

解析：Nelson根据各牙的（牙合）力、牙冠及牙根形态，以及牙周组织等，以上、下第一磨牙压力比值100为基准，制定出各牙（牙合）力的相关比值。并提出“桥基牙（牙合）力比值总和的两倍，应等于或大于固定桥各基牙及缺失牙（牙合）力比值的总和”。即基牙的数量应根据基牙与缺失牙（牙合）力的比值大小来衡量。掌握“固定桥的生理基础”知识点。